患者，男，68岁，肺癌晚期，平日早晚8点使用吗啡缓释片控制疼痛。目前出现暴发性疼痛，应采取的治疗措施是
A. 即刻加用吗啡缓释片一次
B. 即刻加用吗啡片一次
C. 即刻加用芬太尼透皮贴剂
D. 即刻加用可待因片一次
E. 即刻注射哌替啶注射液一次

正确答案：E。即刻注射哌替啶注射液一次

解析：本题考查用于缓解癌症疼痛的药物。患者属癌症晚期，应用速释阿片类制剂处理突破性疼痛，应采取的治疗措施是即刻注射哌替啶注射液一次（E对）。强阿片类药物包括吗啡、哌替啶、可待因、芬太尼等。患者先前已经使用吗啡缓释片来控制疼痛，当出现暴发性疼痛时，应采用起效快的给药方式，选择即刻注射哌替啶注射液一次。